以下不属于头颈部环形组淋巴结群的是
A. 枕淋巴结
B. 耳后淋巴结
C. 腮腺淋巴
D. 面淋巴结
E. 副神经淋巴结

正确答案：E。副神经淋巴结

解析：本题考查头颈部淋巴的分组。环形组淋巴结群主要指从枕部、耳周、下颌下到颏下的区域淋巴结群，由后向前环绕头颈部交界处排列，包括枕淋巴结（A对）、耳后淋巴结（B对）、腮腺淋巴结（C对）、面淋巴结（D对）、下颌下淋巴结及颏下淋巴结。副神经淋巴结（E错，为本题正确答案）为纵形组淋巴结群。